有关急性单纯性阑尾炎，最不符合其临床表现的是
A. 右下腹局限性压痛
B. 脐周疼痛
C. 白细胞计数轻度升高
D. 局部腹肌紧张
E. 厌食、恶心

正确答案：D。局部腹肌紧张

解析：急性单纯性阑尾炎时，病变多只限于黏膜和黏膜下层，浆膜层可有少量炎性渗出，当阑尾炎加重，出现化脓、坏疽或穿孔等病理改变，炎症累及壁层腹膜时，可出现反跳痛，腹肌紧张（D错，为本题正确答案），肠鸣音减弱或消失等腹膜刺激征象。急性阑尾炎最常见的重要体征为右下腹压痛（A对），其典型的腹痛发作始于上腹，逐渐移向脐部（B对），6～8小时后转移并局限在右下腹。急性单纯性阑尾炎，属轻型阑尾炎或病变早期。病变多只限于黏膜和黏膜下层，临床症状和体征均较轻，全身感染症状一般较轻，可有厌食、恶心（E对）、白细胞轻度升高等表现（C对）。